略呈菱状方形或短圆柱形，两端平行倾斜的药材是
A. 地肤子
B. 丝子
C. 决明子
D. 牛蒡子
E. 枳壳

正确答案：C。决明子

解析：本题考查的是决明子药材的性状鉴别。略呈菱状方形或短圆柱形，两端平行倾斜的药材是决明子（C对）。决明子：【性状鉴别】药材决明略呈菱状方形或短圆柱形，两端平行倾斜。表面绿棕色或暗棕色，平滑有光泽。一端较平坦、另端斜尖，背腹面各有1条突起的棱线，棱线两侧各有1条斜向对称而色较浅的线形凹纹。质坚硬，不易破碎。种皮薄，子叶2，黄色，呈“S”形折曲并重叠。气微，味微苦。地肤子（A错）：【性状鉴别】药材呈扁球状五角星形。外被宿存花被，表面灰绿色或浅棕色，周围具膜质小翅5枚，背面中心有微突起的点状果梗痕及放射状脉纹5～10条；剥离花被，可见膜质果皮，半透明。种子扁卵形，黑色。气微，味微苦。菟丝子（B错）：【性状鉴别】药材呈类球形。表面灰棕色或黄棕色，粗糙，种脐线形或扁圆形。质坚实，不易以指甲压碎。气微，味淡。牛蒡子（D错）：呈长倒卵形，略扁，微弯曲。表面灰褐色，带紫黑色斑点，有数条纵棱，通常中间1～2条较明显。顶端钝圆，稍宽，顶面有圆环，中间具点状花柱残迹；基部略窄，着生面色较淡。果皮较硬，子叶2，淡黄白色，富油性。气微，味苦后微辛而稍麻舌。枳壳（E错）：【性状鉴别】药材呈半球形。外果皮棕褐色至褐色，有颗粒状突起，突起的顶端有凹点状油室；有明显的花柱残迹或果梗痕。切面中果皮黄白色，光滑而稍隆起，边缘散有1～2列油室，瓤囊7～12瓣，少数至15瓣，汁囊干缩呈棕色至棕褐色，内藏种子。质坚硬，不易折断。气清香，味苦、微酸。